热性哮喘发作期的正确治法是
A. 温肺散寒，化痰平喘
B. 清热宣肺，化痰定喘
C. 补肺固表，纳气平喘
D. 祛邪扶正，标本兼顾
E. 解表清里，定喘止咳

正确答案：B。清热宣肺，化痰定喘

解析：热性哮喘发作期的病机为痰热壅肺，肺失清肃，肺气上逆，故当治以清热宣肺、化痰定喘（B对），方药选用清肺化痰定喘的定喘汤加减。温肺散寒，化痰平喘（A错），是寒哮证的治法。补肺固表，纳气平喘（C错），是脾肾虚弱之哮喘的治法。祛邪扶正，标本兼顾（D错），用于治疗正虚邪犯证；解表清里，定喘止咳（E错），用于治疗风热犯肺之咳嗽。